以下是生态系统的特征，哪项除外
A. 整体性
B. 开放性
C. 自调控
D. 可复制性
E. 可持续性

正确答案：D。可复制性

解析：本题考查生态系统的特征。生态系统是在一定空间范围内，由生物群落及其环境组成，借助于各种功能流（物质流能量流、物种流和信息流）所联结的稳态系统。它具有整体性（A对）、开放性（B对）、自调控（C对）、可持续性（E对）等特征。可复制性（D错，为本题正确答案）不是生态系统的特征。